在T细胞活化中发挥重要作用的分子是
A. CTLA-4
B. CD28
C. PD-1
D. CD2
E. CD40L

正确答案：B。CD28